心烦不寐患者，脉象多见
A. 滑
B. 促
C. 弦
D. 涩
E. 数

正确答案：E。数

解析：心烦不寐患者多因阴液亏少，心神失养，虚火扰神，神不守舍所致；而数脉可因久病阴虚，虚热内生所致而见脉象细数而力度稍弱，故心烦不寐患者，脉象多见数脉（E对）。滑脉多见于痰湿、食积和实热等病证，亦是青壮年的常脉，妇女的孕脉（A错）。促脉多见于阳盛实热、气血痰食停滞，亦见于脏气衰败（B错）。弦脉多见于肝胆病、疼痛、痰饮等，或为胃气衰败者。亦见于老年健康者（C错）。涩脉多见于气滞、血瘀和精伤、血少（D错）。